龋病组织颜色深，呈棕黑色，质地较硬，成人及老年人多数患的龋病是
A. 急性龋
B. 窝沟龋
C. 原发龋
D. 静止性龋
E. 慢性龋

正确答案：E。慢性龋

解析：慢性龋也称缓慢进展性龋，病变进展慢，病变组织颜色深，呈棕褐色、棕黑色，质地较硬。一般成人及老人龋病多见此类型。掌握“牙釉质龋”知识点。